女性，22岁，因右下智齿低位埋伏阻生，要求拔除。常用的麻药是
A. 2％利多卡因
B. 1％普鲁卡因
C. 1％丁卡因
D. 2％利多卡因加肾上腺素
E. 1％普鲁卡因加肾上腺素

正确答案：D。2％利多卡因加肾上腺素

解析：本题考查局麻药。临床上最常的用的局麻药为含1：100000肾上腺素的2％利多卡因（D对A错）。拔除右下颌低位埋伏阻生智齿时创伤较大，出血较多，应在常规麻药2%利多卡因内加入肾上腺素，以起到收缩血管，减少出血的作用。普鲁卡因（BE错）偶尔能引起过敏反应，现在临床上已很少使用。丁卡因（C错）多用于表面麻醉。